男，55岁。因持续胸痛10小时收入院。查体：BP120/80mmHg，高枕卧位，双肺可闻及较多细湿啰音，啰音范围大于1/2肺野。心电图示：V₁～V₄导联ST段抬高0.2～0.4mV。该患者的心功能分级是
A. KillipⅡ级
B. NYHAⅢ级
C. NYHAⅣ级
D. KillipⅣ级
E. KillipⅢ级

正确答案：E。KillipⅢ级

解析：患者中老年男性，持续胸痛10小时，心电图示：V₁～V₄导联ST段抬高0.2～0.4mV，考虑诊断为急性ST段抬高型心肌梗死。故该患者心功能分级应按照Killip分级法，查体：双肺可闻及较多细湿啰音，啰音范围大于1/2肺野，因此该患者的心功能分级为KillipⅢ级（E对AD错）。而NYHA分级（P168）是没有急性心肌梗死但患有心力衰竭的患者的心功能分级标准，共分为四级，其中NYHA分级Ⅲ级（B错）指心脏病患者体力活动明显受限，低于平时一般活动即引起心衰症状；NYHA分级Ⅳ级（C错）指心脏病患者不能从事任何体力活动，休息状态下也存在心衰症状，活动后加重。